患者，男，56岁。高热不退，烦闷躁扰，手足抽搐，时有角弓反张，舌绛而干，脉弦而数。治疗应首选
A. 紫雪
B. 天麻钩藤饮
C. 羚角钩藤汤
D. 镇肝熄风汤
E. 安宫牛黄丸

正确答案：C。羚角钩藤汤

解析：患者高热不退，舌绛而干，脉弦而数提示肝经热盛，体内津液已伤；烦闷躁扰，手足抽搐，时有角弓反张，是肝经热盛，热极生风的表现，治疗宜凉肝息风，增液舒筋故采用羚角钩藤汤（C对）。紫雪（A错）的功用为清热开窍，息风止痉。主治：热闭心包，热盛动风证。天麻钩藤饮（B错）主治肝阳偏亢，肝风上扰证。镇肝熄风汤（D错）的功用为镇肝息风，滋阴潜阳。主治：类中风。安宫牛黄丸（E错）的功用为清热解毒，豁痰开窍。主治：邪热内陷心包证。